某地某年男性简略寿命表中0岁组的期望寿命是65.5岁。该寿命表中1岁组的期望寿命是
A. 等于65.5岁
B. 小于65.5岁
C. 大于65.5岁
D. 等于66.5岁
E. 不一定

正确答案：E。不一定

解析：本题考查期望寿命的变化规律。一般情况下，随着X的增大，期望寿命会减少，但在较高婴儿死亡率的国家，“1～”岁组期望寿命反而可能高于“0～”岁组期望寿命。因此不一定（E对ABCD错）确定0岁组的期望寿命和1岁组的期望寿命的大小关系。